属于钠通道阻滞剂（第Ⅰa类）的抗心律失常的药是
A. 维拉帕米
B. 胺碘酮
C. 美西律
D. 拉贝洛尔
E. 普鲁卡因胺

正确答案：E。普鲁卡因胺

解析：本题考查普鲁卡因胺。普鲁卡因胺（E对）为Ⅰa类钠通道阻滞剂，属于广谱抗心律失常药。维拉帕米（A错）为非二氢吡啶类钙通道阻滞剂。胺碘酮（B错）属Ⅲ类抗心律失常药,具有轻度非竞争性的α及β肾上腺素受体阻滞剂以及轻度Ⅰ及Ⅳ类抗心律失常药性质。美西律（C错）属于Ⅰb类抗心律失常药，主要用于急慢性室性心律失常。拉贝洛尔（D错）为β受体阻断剂，产生周围血管舒张作用。